心肌肥大，下述何种概念是错误的？
A. 主要是心肌细胞体积增大
B. 单位重量肥大心肌的舒缩性能是降低的
C. 心脏总的收缩力增强
D. 使心脏在相当长时间内处于功能稳定状态
E. 能有效地防止心衰的发生

正确答案：E。能有效地防止心衰的发生

解析：慢性心功能不全时，心脏通过心室重塑进行代偿，心肌肥大属于心室重塑的一种。心肌肥大主要是指心肌细胞体积增大（A对），在细胞水平上表现为细胞长度增加，在器官水平上表现为心室重量增加。心肌肥大时单位重量肥大心肌的舒缩性能是降低的（B对），但因为整个心脏的重量增加，所以心脏总的收缩力增强（C对）。代偿期的心肌肥大可维持心脏收缩力使心脏在相当长时间内处于功能稳定状态（D对），但心肌肥大有一定限度，过度肥大的心肌会发生缺血、缺氧等改变，使心功能不全进入失代偿期，因而心肌肥大不能有效地防止心衰的发生（E错，为本题正确答案）。